两个样本均数比较作t检验，其他条件不变，犯第Ⅱ类错误的概率最小的是
A. α=0.05
B. α=0.01
C. α=0.1
D. α=0.2
E. 该问题提法不对

正确答案：D。α=0.2

解析：α越大，假阴性就越大，就是说不拒绝本来错误的二类错误就会变大。